有机磷杀虫药对人体的毒性主要是
A. 增加乙酰胆碱的产生
B. 抑制乙酰胆碱酶活力
C. 抑制中枢神经系统
D. 血液凝固障碍
E. 急性肾功能衰竭

正确答案：B。抑制乙酰胆碱酶活力